能吸附热原的是
A. 滑石粉
B. 活性炭
C. 两者均采用
D. 两者均不采用

正确答案：B。活性炭

解析：本题考查去除热原的方法。活性炭（B对）是常用的吸附剂，用量一般为溶液体积的0.1%～0.5% 。活性炭的吸附作用强，除了吸附热原外，还有脱色、助滤作用。滑石粉（ACD错）是片剂中常用的润滑剂。